下列哪项在心主血脉中起关键作用
A. 心血充盈
B. 心气充沛
C. 心神安宁
D. 心搏如常
E. 脉道通利

正确答案：B。心气充沛

解析：因为心、脉、血三者密切相连，构成一个血液循环系统。血液在脉中正常运行，必须以心气充沛，血液充盈，脉管通利为基本条件。其中心气充沛（B对）又起着主导作用，对血液循环系统生理功能的正常发挥起着主导作用。注：该题根据七版教材所述，心脏的正常搏动对血液循环系统生理机能的正常发挥起着主导作用。即心搏如常起主导作用。当年该题的答案依据七版教材，为心搏如常。而新版教材中所述为心气充沛起主导作用，心气对心脏搏动起到推动和调控的作用，心气充沛为心搏如常的先决条件，故针对答案做出修正。